婴儿腹泻治疗原则包括以下内容，哪项除外
A. 调整和适当饮食限制
B. 纠正水电解质紊乱
C. 加强护理，防止并发症
D. 控制肠道内外感染
E. 长期应用广谱抗生素

正确答案：E。长期应用广谱抗生素

解析：婴儿腹泻治疗原则：调整饮食（A对），预防和纠正脱水（B对），合理用药，加强护理，预防并发症（C对），药物治疗控制感染（D对）。不同时期的腹泻治疗重点各有侧重，急性腹泻多注意维持水、电解质平衡；迁延性及慢性腹泻则应注意肠道菌群失调及饮食疗法。其中合理用药指根据不同的菌群使用不同的抗菌药物，而不应该长期应用广谱抗生素（E错，为本题正确答案），后者会造成菌群失调，加重疾病症状。